在低浓度大气污染物长期作用下易诱发下列何种疾病
A. 高血压
B. 腰痛
C. 呼吸系统感染性疾病
D. 关节炎
E. 肩周炎

正确答案：C。呼吸系统感染性疾病

解析：本题考查低浓度大气污染物长期作用下易诱发的疾病。在低浓度大气污染物长期作用下易诱发呼吸系统感染性疾病（C对ABDE错）。大气污染物主要包括有机物、无机物、重金属、细颗粒物等，其中细颗粒物是最容易进入人体的，它们可以通过呼吸道进入肺部，并在肺部积聚，影响肺部的正常功能，从而导致呼吸系统感染性疾病，如支气管炎、肺炎、肺结核等。